关于孕期用药以下哪项是不正确的
A. 孕早期用药不当可致胎儿畸形
B. 孕中期器官功能发育快，用药应谨慎
C. 孕晚期用药不当有时会影响胎儿和生后健康
D. 孕期用药对胎儿的不良影响常大于疾病本身对胎儿的影响
E. 因药物常从乳汁排出，哺乳期用药应谨慎

正确答案：D。孕期用药对胎儿的不良影响常大于疾病本身对胎儿的影响

解析：本题考查孕期用药的相关内容。究竟是用药还是疾病本身对胎儿的影响大，这主要是看是何种疾病，并不能一概而论（D错，为本题正确答案）。孕期用药时：孕早期用药不当可致胎儿畸形（A对）；孕中期器官功能发育快，用药应谨慎（B对）；孕晚期用药不当有时会影响胎儿和生后健康（C对）；因药物常从乳汁排出，哺乳期用药应谨慎（E对）等。